餐中服用，可以减少对胃肠道刺激的药品是
A. 复方铝酸铋片
B. 二甲双胍片
C. 甲氧氯普胺片
D. 瑞舒伐他汀片
E. 维生素C

正确答案：B。二甲双胍片

解析：本题考查药品服用的适宜时间。二甲双胍（B对）宜餐中服用，可以减少对胃肠道的刺激和不良反应。复方铝酸铋（A错）为胃黏膜保护药，宜于餐前服用。甲氧氯普胺（C错）为促胃动力药，餐前服用利于助消化。瑞舒伐他汀（D错）宜睡前服用，因为肝脏合成胆固醇峰期多在夜间，晚餐后服药有助于提高疗效。